外周免疫器官包括
A. 骨髓、淋巴结、脾脏
B. 胸腺、脾脏、粘膜组织
C. 法氏囊、脾脏、扁桃体
D. 脾脏、淋巴结、其他淋巴组织
E. 扁桃体、骨髓、淋巴结

正确答案：D。脾脏、淋巴结、其他淋巴组织